下列是合成甘油三酯的主要场所的是
A. 小肠
B. 胃
C. 肾脏
D. 心脏
E. 胆囊

正确答案：A。小肠

解析：肝、脂肪组织和小肠是合成甘油三酯的主要场所。掌握“甘油磷脂、胆固醇和血脂蛋白代谢”知识点。